患者男，63岁，体胖，有高血压和糖尿病史。饱餐后突感心前区闷痛，伴有气短痰多，纳呆恶心，含服硝酸甘油2分钟疼痛缓解；舌苔浊腻，脉滑。心电图示V₃～V₆波倒置，心肌酶正常。应首先考虑的是
A. 冠心病心肌梗死寒凝心脉证
B. 冠心病心绞痛气虚血瘀证
C. 冠心病心绞痛心血瘀阻证
D. 冠心病心绞痛痰浊内阻证
E. 冠心病心肌梗死气滞血瘀证

正确答案：D。冠心病心绞痛痰浊内阻证

解析：患者男，63岁（本病男性多于女性，多数患者在40岁以上），体胖，有高血压和糖尿病史（患者基础情况较差），饱餐（为常见诱因），突感心前区闷痛（典型特点为发作性的心前区压榨性疼痛，主要位于胸骨后，可放射至心前区和左上肢内侧，常发生于劳力负荷增加时，持续数分钟），含服硝酸甘油2分钟疼痛缓解，心电图示V₃～V₆波倒置（大多数患者可出现典型的缺血性改变，即以R波为主的导联中，出现ST段压低≥0.1mV，有时出现T波倒置），心肌酶正常（急性心肌梗死示心肌酶异常）。患者痰浊阻肺，宣降失常故见气短痰多；痰浊中阻，胃失和降故见纳呆恶心；痰浊内阻故见舌苔浊腻，脉滑（D对）。心肌梗死寒凝心脉证宜散寒宣痹，芳香温通。方药：当归四逆汤合苏合香丸加减（A对）。心绞痛气虚血瘀证宜益气活血，通脉止痛。方药：补阳还五汤加减（B对）。心绞痛心血瘀阻证宜活血化瘀，通脉止痛。方药：血府逐瘀汤加减（C对）。心肌梗死气滞血瘀证宜活血化瘀，通络止痛。方药：血府逐瘀汤加减（E对）。